女，26岁。产后面色变红、肥胖1年半，乏力、头痛加重半年，并口渴多饮，夜间尿量达1700ml比白天多。查体：血压180/126mmHg、脉率104次/分，向心性肥胖，面色红黑有痤疮，皮肤薄乳晕及指关节伸侧色较深，腹壁胭窝及腋窝周围有紫纹，双下肢有可凹性水肿。最可能的诊断是
A. 产后高血压伴肥胖
B. 2型糖尿病
C. 醛固酮增多症
D. 库欣综合征
E. 肾上腺嗜铬细胞瘤

正确答案：D。库欣综合征

解析：青年女性患者，产后出现向心性肥胖，面色红黑有痤疮、皮肤薄、乳晕及指关节伸侧色较深、腹壁胭窝及腋窝周围紫纹等皮肤表现，乏力头痛等肌肉神经系统表现，高血压、口渴多饮、夜尿增多、双下肢可凹性水肿等心血管系统表现及代谢障碍，符合库欣综合征的典型表现（P699），考虑诊断为库欣综合征（D对）。产后高血压伴肥胖（A错）可有腹部白色条纹，紫色条纹少见，且不会出现面色红黑、痤疮、皮肤薄、乳晕及指关节伸侧色深。2型糖尿病（B错）典型表现为多饮、多食、多尿、体重减轻，无向心性肥胖、紫纹、面色发黑、痤疮等皮肤表现（P729）。醛固酮增多症（C错）可表现为高血压、低血钾、乏力头痛，但是无向心性肥胖、多血质、紫纹等表现（P703-P704）。肾上腺嗜铬细胞瘤（E错）的特征性表现为阵发性高血压，但是无向心性肥胖、满月脸、多血质、紫纹等表现（P710）。